女，35岁。颈部肿块4年余，随吞咽上下移动。近3个月肿块增大明显。手术切除后病理诊断为甲状腺滤泡状腺癌。其最主要的病理诊断依据是
A. 甲状腺滤泡上皮细胞明显异型性
B. 甲状腺间质中出现大量淀粉样物质
C. 甲状腺滤泡上皮细胞侵犯包膜
D. 甲状腺滤泡上皮细胞核呈毛玻璃样改变
E. 甲状腺组织内出现乳头结构

正确答案：C。甲状腺滤泡上皮细胞侵犯包膜

解析：甲状腺滤泡状腺癌是甲状腺向滤泡分化形成的恶性肿瘤，缺乏乳头状癌的诊断特征。常比乳头状癌预后差，占甲状腺癌的20% -25%。多发于40岁以上女性，易发生血道转移。分化极好的滤泡状癌很难与腺瘤区别，需对肿瘤及包膜多处取材、切片，尤其是否有包膜和血管侵犯加鉴别（C对）。甲状腺间质中出现大量淀粉样物质为髓样癌（B错）。甲状腺组织内出现乳头结构、细胞核呈毛玻璃样改变为乳头状癌（DE错）。